对药品生产企业处以100万罚款属于
A. 行政处罚
B. 行政处分
C. 行政强制执行
D. 行政强制措施

正确答案：A。行政处罚

解析：本题考查行政执法的种类。药事监管组织行政执法的类别主要包含行政许可、行政处罚、行政强制、行政检查等。其中行政处罚（A对）的种类包括：警告；罚款；没收违法所得、没收非法财物；责令停产停业；暂扣或者吊销许可证、暂扣或者吊销执照；行政拘留；法律、行政法规规定的其他行政处罚。行政处分（B错）指由有管辖权的国家机关或企事业单位依据行政隶属关系对违法失职人员给予的一种行政制裁。其种类主要有警告、记过、记大过、降级、撤职、开除六种。其中行政强制包括行政强制措施和行政强制执行。行政强制执行（C错）的方式包括：①加处罚款或者滞纳金；②划拨存款、汇款；③拍卖或者依法处理查封、扣押的场所、设施或者财物；④排除妨碍、恢复原状；⑤代履行；⑥其他强制执行方式。其中行政强制包括行政强制措施和行政强制执行。行政强制措施（D错）包括：①限制公民人身自由；②查封场所、设施或者财物；③扣押财物；④冻结存款、汇款；⑤其他行政强制措施。